精神障碍的社会根源不包括
A. 原有社会、经济、文化和心理基础的破坏
B. 人身自由失去保障
C. 被动移民和难民增加
D. 正常的人际关系
E. 对精神病人进行社会隔离

正确答案：D。正常的人际关系

解析：本题考查精神障碍的社会根源。精神障碍的社会根源主要包括：1.社会文化因素与精神障碍的确定；2.社会结构因素与精神障碍的分布；3.社会动荡与精神障碍，包括：①原有社会经济、文化和心理基础的破坏（A对）；②精神应激的增加，即人身自由失去保障（B对）；③被动移民和难民增加（C对）；4.文化源性应激；5.对精神病人的歧视，包括：①不尊重精神病人的人格，剥夺精神病人的基本权利；②将精神障碍裁定为非道德的行为而加以歧视和谴责；③对精神病人进行社会隔离（E对）。正常的人际关系（D错，为本题正确答案）不属于引起精神障碍的社会根源。